沟纹舌的临床表现
A. 舌背部脑回状或叶脉状皱褶
B. 舌背中部丝状乳头增生呈麦浪状
C. 舌背乳头萎缩与增生并存似蜿蜒国界
D. 舌背丝状乳头萎缩甚至消失
E. 舌背后部似菱形的舌乳头萎缩

正确答案：A。舌背部脑回状或叶脉状皱褶

解析：本题考查唇、舌疾病。沟纹舌的临床表现为舌背部脑回状或叶脉状皱褶（A对）。沟纹舌以舌背不同形态、不同排列、不同深浅长短、不同数目的沟纹或裂纹为特征，形状似脑回、叶脉或树枝样，也可发生在舌侧缘。以舌尖抵于下前牙舌面将舌拱起，或用前牙轻咬舌体，可清晰见到张开的沟裂样损害。但沟底黏膜连续完整，无渗血。沟底丝状乳头缺如，沟侧壁丝状乳头稀少。